左心衰竭患者合并右心衰竭后，可能减轻的左心衰竭临床症状是
A. 恶心
B. 喘憋
C. 肝肿大
D. 颈静脉充盈
E. 下肢水肿

正确答案：B。喘憋

解析：左心衰竭患者由于肺部淤血而发生喘憋症状，右心衰竭时右心排血量减少，肺淤血水肿减轻，因此喘憋（B对）等肺淤血所导致的症状反而有所减轻。恶心（A错）、肝肿大（C错）、颈静脉充盈（D错）和下肢水肿（E错）均是右心衰竭常见的临床表现，左心衰竭患者合并右心衰竭后此类临床表现不可能减轻。